以缺血性静息痛为主要症状时，提示血栓闭塞性脉管炎的分期是
A. Ⅳ期
B. Ⅱb期
C. Ⅱa期
D. Ⅱ期
E. Ⅲ期

正确答案：E。Ⅲ期

解析：血管闭塞性脉管炎的临床分期与动脉硬化性闭塞症相同。I期：患肢无明显临床症状，或仅有麻木、发凉自觉症状。Ⅱ期：以间歇性跛行为主要症状（D错）。Ⅲ期：以静息痛为主要症状（E对）。Ⅳ期：患肢除静息痛外，出现趾（指）端发黑、干瘪、坏疽或缺血性溃疡等（A错）。